窦房结的动脉多数起自
A. 左冠状动脉
B. 右冠状动脉
C. 前室间支
D. 后室间支
E. 旋支

正确答案：B。右冠状动脉

解析：窦房结的动脉多数约60%起自右冠状动脉（B对），多以逆时针方向，或以顺时针方向绕上腔静脉口穿入窦房结。